非甾体抗炎药引起急性胃炎的主要机制是
A. 激活磷脂酶A
B. 抑制前弹性蛋白酶
C. 抑制前列腺素合成
D. 促进胃泌素合成
E. 抑制脂肪酶

正确答案：C。抑制前列腺素合成